肉眼观察肾体积明显缩小，质地变硬，表面有大的不规则瘢疤凹陷，该病变性质最可能是
A. 晚期肾小球肾炎
B. 局灶性节段性肾小球肾炎
C. 轻微病变性肾小球肾炎
D. 良性高血压病引起的萎缩肾
E. 慢性肾盂肾炎

正确答案：E。慢性肾盂肾炎

解析：肉眼观察肾体积明显缩小，质地变硬，表面有大的不规则瘢疤凹陷是慢性肾盂肾炎（E对）的特点。晚期肾小球肾炎（P273）（A错）肉眼观双肾体积缩小，表面呈弥漫性细颗粒性，称为继发性颗粒性固缩肾。局灶性节段性肾小球肾炎（P271）（B错）的病变特点为部分肾小球的部分小叶发生硬化。轻微病变性肾小球肾炎（P270）（C错）肉眼观肾脏肿胀，颜色苍白。良性高血压病引起的萎缩肾（P141）（D错）肉眼观，双侧肾脏对称性缩小，质地变硬，肾表面凹凸不平，呈细颗粒状。